下列哪项不属于潜在致癌物
A. 钴
B. 铬
C. 硒
D. 锌

正确答案：B。铬

解析：本题考查潜在致癌物。潜在致癌物是指在动物实验中已获得阳性结果，但在人群中尚无资料表明对人类有致癌性。钴（A对）、硒（C对）、锌（D对）属于潜在致癌物。铬（B错，为本题正确答案）属于确认致癌物。